WHO高血压与冠心病专家委员会1959年对青少年血压上限的界定标准是
A. 12岁以下为135/85mmHg，13岁以上为140/90mmHg
B. 13岁以下为135/85mmHg，14岁以上为140/90mmHg
C. 12岁以下为130/85mmHg，13岁以上为135/90mmHg
D. 14岁以下为135/85mmHg，15岁以上为140/90mmHg
E. 14岁以下为130/85mmHg，15岁以上为140/90mmHg

正确答案：A。12岁以下为135/85mmHg，13岁以上为140/90mmHg